尿路感染的主要病机是
A. 湿热蕴结下焦，膀胱气化不利
B. 湿热蕴结中焦，膀胱气化失司
C. 湿热蕴结肝胆，肝胆疏泄失常
D. 肾气亏虚，肾失蒸化开合
E. 肾阴亏虚，湿热蕴结

正确答案：A。湿热蕴结下焦，膀胱气化不利

解析：尿路感染的主要病机是湿热蕴结下焦，肾与膀胱气化不利（A对），主要与湿热毒邪蕴结膀胱及脏腑功能失调有关。具体病因包括：外阴不洁，移浊之邪入侵膀胱；饮食不节，损伤脾胃，蕴湿生热；情志不遂，气郁化火或气滞血瘀；年老体弱、禀赋不足、房事不节及久淋不愈引起脾肾亏虚等。